糖尿病合并妊娠，孕期血糖控制良好，终止妊娠的理想时间是
A. 妊娠32～33周
B. 妊娠38～39周
C. 妊娠34～35周
D. 妊娠36～37周
E. 妊娠40周

正确答案：B。妊娠38～39周

解析：原八版教材糖尿病合并妊娠是指在原有糖尿病的基础上合并妊娠，即妊娠前糖尿病。妊娠前糖尿病患者，如孕期血糖控制良好，严密监测下，妊娠38～39周（B对）终止妊娠；有母儿合并症者，血糖控制不满意者，适时终止妊娠。现九版教材妊娠39周后可终止妊娠。